室性心动过速伴严重血液动力学障碍时，终止发作的首选方法是
A. 利多卡因
B. 胺碘酮
C. 同步电复律
D. 人工起搏超速抑制
E. 压迫颈动脉窦

正确答案：C。同步电复律

解析：室性心动过速伴严重血液动力学障碍时，终止发作的首选方法是应迅速施行同步电复律（C对）。若患者如无显著的血流动力学障碍，首先给予静脉注射利多卡因（A错）或普鲁卡因胺，同时静脉持续滴注。对于心肌梗死或心力衰竭且无显著的血流动力学障碍的患者，可选用胺碘酮（B错）治疗。持续性室速患者，如病情稳定，可应用人工起搏超速抑制（D错）终止心动过速。压迫颈动脉窦（P193）（E错）为刺激迷走神经的一种方法，主要用于室上性心动过速且心功能与血压正常的患者。